选磨方法中错误的有
A. 一般先磨正中的早接触区，不轻易磨改功能牙尖
B. 侧方的磨改要兼顾工作侧与非工作侧
C. 选磨工作应一次完成、减少患者就诊次数
D. 选磨结束必须用硬橡皮轮将牙面抛光，以减少菌斑的堆积
E. 对于因选磨暴露牙本质出现过敏症状的，应进行脱敏治疗

正确答案：C。选磨工作应一次完成、减少患者就诊次数

解析：本题考查选磨方法。选磨工作一次完成，患者易疲劳，影响正确的咬合运动及妨碍对早接触或（牙合）干扰的准确定位，所以不能为了减少患者就诊次数，选磨工作一次完成（C错，为本题的正确答案）。选磨方法即用砂石轮等磨改牙齿外形以消除创伤性（牙合）的方法。选磨方法一般先磨正中的早接触区，不轻易磨改功能牙尖（A对），因为功能性牙尖是保持垂直距离和维持正常咬合关系的关键，若被磨除会导致垂直距离降低、咀嚼效率下降。侧方的磨改要兼顾工作侧与非工作侧（B对），才能达到侧方（牙合）无（牙合）干扰。选磨结束必须用硬橡皮轮将牙面抛光，以减少菌斑的堆积（D对），减少龋病的发生机会。对于因选磨暴露牙本质出现过敏症状的，应进行脱敏治疗（E对），否则会继牙髓炎等其他疾病。